温热药的功效是
A. 凉血
B. 温里
C. 活血
D. 驱虫
E. 利水

正确答案：B。温里

解析：本题考查的是药物四气的所示效用。温热药的功效是散寒（B对）。四气，从本质而言只有寒热二性。凡寒凉性药物，即表示其具有清热、泻火、凉血（A错）、解热毒等作用；凡温热性药物，即表示其具有温里散寒、补火助阳、温经通络、回阳救逆等作用。四气对人体的作用也有两面性，倘若应用不当，即可对人体产生不良作用。此时，寒凉性有伤阳助寒之弊，而温热性则有伤阴助火之害。活血（C错）为辛味的作用。辛：能散、能行，有发散、行气、活血作用。利水（E错）为淡味的作用。淡：能渗、能利，有渗湿利水作用。